关于身体活动的说法，不正确的是
A. 不同的活动类型促进健康的作用不相同
B. 适度增加身体活动可以获得更大的健康效益
C. 高强度的身体活动可能造成身体损伤
D. 成人每周应至少参加五次以上中等强度的身体活动
E. 高血压患者不应该参加身体活动

正确答案：E。高血压患者不应该参加身体活动

解析：不同的活动类型促进健康的作用不相同，适度增加身体活动可以获得更大的健康效益，高强度的身体活动可能造成身体损伤，成人每周应至少参加五次以上中等强度的身体活动（ABCD对）。患高血压、糖尿病等不影响活动的慢性非传染性疾病患者建议参加身体活动（E错，为本题正确答案）。